掌跖角化-牙周破坏综合征（PLS）临床表现错误的是
A. 皮损及牙周病变常在4岁前共同出现
B. 手掌及肘部局限性的过度角化及鳞屑、皲裂
C. 足底、膝部局限性的过度角化及鳞屑、皲裂
D. 手掌、足底及肘部局限性的过度角化及鳞屑、皲裂
E. 患儿智力低下，但身体发育正常

正确答案：E。患儿智力低下，但身体发育正常

解析：掌跖角化-牙周破坏综合征（PLS）皮损及牙周病变常在4岁前共同出现，有人报道可早在出生后11个月发生。皮损包括手掌、足底、膝部及肘部局限性的过度角化及鳞屑、皲裂，有多汗和臭汗。约有1/4患者易有身体其他处感染。患儿智力及身体发育正常。掌握“反应全身疾病的牙周炎”知识点。